崩漏的治疗，应本着的原则
A. 治崩三法
B. 急则治其标，缓则治其本
C. 辨证论治
D. 补气摄血
E. 或补肾，或扶脾，或疏肝

正确答案：B。急则治其标，缓则治其本

解析：崩漏属急证、血证，应急则治其标，缓则治其本（B对）。崩漏应在急则治其标，缓则治其本的原则上，灵活运用治崩三法（A错）。（CDE错）。